有关眼球各结构的功能描述，错误的是
A. 屈光系统能控制进入眼球内光线的量
B. 脉络膜有吸收眼球内分散光线的作用
C. 房水对角膜和晶状体有营养作用
D. 眼球纤维膜的一部分有屈光作用
E. 玻璃体有支持视网膜的作用

正确答案：A。屈光系统能控制进入眼球内光线的量

解析：能控制进入眼球内光线的量的是虹膜，而非屈光系统（A错，为本题正确答案）